湿邪致病缠绵难愈的主要原因是
A. 湿性重浊，留滞于体内，病难速愈
B. 湿性黏滞，不易祛除，病难速愈
C. 湿邪损伤阳气，阳气受损，病难速愈
D. 湿为阴邪，易阻遏气机，病难速愈
E. 湿性趋下，易袭阴位，病难速愈

正确答案：B。湿性黏滞，不易祛除，病难速愈

解析：湿邪治病缠绵难愈是因湿性黏滞，易阻气机，气不行则湿不化，胶着难解，故湿邪为病，起病隐缓，病程较长，反复发作，或缠绵难愈，如湿温、湿疹、湿痹（着痹）等，皆因其湿邪难除而不易速愈，或反复发作。吴瑭《温病条辨.上焦篇》谓：“其性氤氲黏腻，非若寒邪之一汗即解，温热之一凉即退，故难速已”（B对）。湿性重浊，常出现以沉重感及附着难移为特征的临床表现（A错）。